病原体的基本特性包括传染力、致病力和以下哪项内容
A. 侵袭力
B. 爆发力
C. 毒力
D. 压力
E. 生存力

正确答案：C。毒力

解析：病原体的基本特性包括：①传染力；②致病力；③毒力。掌握“传染病预防及控制”知识点。